鼻咽
A. 上达颅底，下至咽峡
B. 顶壁后部粘膜内，有咽扁桃体
C. 后壁上有咽鼓管咽口连鼓室
D. 咽鼓管圆枕与下鼻甲续连
E. 咽隐窝是蝶窦的开口

正确答案：B。顶壁后部粘膜内，有咽扁桃体

解析：鼻咽上达颅底，下到腭帆游离缘平面续口咽(A错)，顶壁后部黏膜内有咽扁桃体(B对)，侧壁上有咽鼓管咽口通鼓室(C错)，咽鼓管圆枕位于咽鼓管咽口的前上后方，不续下鼻甲(D错)，咽隐窝位于咽鼓管圆枕与咽后壁之间，不为蝶窦开口(E错)。